继发性腹膜炎的手术指征是
A. 非手术治疗24小时后，病情加重
B. 原发病情况好转时
C. 中毒休克症状转好时
D. 病因不明
E. 腹膜炎有局限趋势后

正确答案：D。病因不明

解析：继发性腹膜炎的手术指征有：①经上述非手术治疗6～8小时后（一般不超过12小时），腹膜炎症状及体征不缓解反而加重者。②腹腔内原发病严重，如胃肠道穿孔或胆囊坏疽、绞窄性肠梗阻、腹腔内脏器损伤破裂、胃肠道手术后短期内吻合口漏所致的腹膜炎。③腹腔内炎症较重，有大量积液，出现严重的肠麻痹或中毒症状，尤其是有休克表现者。④腹膜炎病因不明确，且无局限趋势者（D对）。